外来化合物对免疫系统作用的特点是
A. 反应的灵敏性，反应的单一性，反应的选择性
B. 反应的灵敏性，反应的双重性，反应的选择性
C. 反应的迟发性，反应的双重性，反应的选择性
D. 反应的退发性，反应的单一性，反应的持久性
E. 反应的持久性，反应的双重性，反应的选择性

正确答案：B。反应的灵敏性，反应的双重性，反应的选择性